一项胰腺癌的病例对照研究，病例组17％的病人被诊断为糖尿病，根据年龄、性别、种族配对的非胰腺癌患者为对照组，仅4％被诊断为糖尿病，由此推断糖尿病在胰腺癌中起了病因的作用
A. 正确
B. 不对，因为没有可比人群
C. 不对，因为在糖尿病和胰腺癌的发生之间没有明确时间顺序
D. 可能不对，因为在胰腺癌病例中缺少糖尿病的确诊
E. 可能不对，因为在非糖尿病患者中缺少胰腺癌的确诊

正确答案：C。不对，因为在糖尿病和胰腺癌的发生之间没有明确时间顺序